成人患者，急性出血，失血量约700ml，烦躁，面色苍白，皮肤湿冷，BP14.7/12.5kPa（110/94mmHg），脉搏100次/分，应属于哪种情况
A. 未发生休克
B. 休克代偿期
C. 中度休克
D. 重度休克
E. 虚脱

正确答案：B。休克代偿期

解析：休克代偿期：有效循环血容量的降低在20%（800ml）以下；临床上患者表现为精神紧张、兴奋或烦躁不安、面色苍白、手足湿冷、心率加速、过度换气等；血压正常或稍高，脉压差缩小，尿量正常或减少。掌握“休克”知识点。